补脾益肠丸为双层水蜜丸。药物组成：外层，黄芪、党参（米炒）、砂仁、白芍、当归（土炒）、白术（土炒）、肉桂；内层，醋延胡索、荔枝核、炮姜、炙甘草、防风、木香、盐补骨脂、煅赤石脂；辅料：聚丙烯酸树脂Ⅱ、炼蜜、滑石粉、菌、蓖麻油、乙醇、淀粉、药用炭、虫白蜡。制法：处方中饮片15味，煅赤石脂粉碎成细粉，每100g内层细粉用炼蜜35g～45g及适量的水泛丸，干燥，用聚丙烯酸树脂Ⅱ等辅料包衣；每100g外层细粉用炼蜜35g～50g及适量水包裹在内层包衣丸上，以药用炭包衣，干燥，抛光，即得。功能与主治：益气养血，温阳行气，涩肠止泻。用于脾虚气滞所致的泄泻，症见腹胀疼痛、肠鸣泄泻、黏液血便；慢性结肠炎、溃疡性结肠炎、过敏性结肠炎见上述证候者。处方中的辅料聚丙烯酸树脂Ⅱ是用作
A. 包药物衣
B. 包糖衣
C. 包缓释衣
D. 包肠溶衣
E. 包控释衣

正确答案：D。包肠溶衣

解析：本题考查的是丸剂的包衣。处方中的辅料聚丙烯酸树脂Ⅱ是用作包肠溶衣（D对）。丸剂包衣可提高药物稳定性，防止主药氧化、变质或挥发，防止吸潮及虫蛀；掩盖臭味、减少药物的刺激性；控制药物作用速度或部位，药物衣（A错）包于丸剂表面，可首先被吸收；包肠溶衣可在肠内溶散吸收；包缓释衣（C错）可制成长效制剂等；还有改善外观，便于识别等作用。不同类型的包衣应选用相宜的包衣材料。（1）药物衣：包衣材料是处方药物制成的极细粉，本身具有一定的药理作用，用于包衣既可首先发挥药效，又可保护丸粒、增加美观。常见的药物衣有朱砂衣（镇静、安神、补心类药物常用）、黄柏衣（利湿、渗水、清下焦湿热的药物常用）、雄黄衣（解毒、杀虫类药物常用）、青黛衣（清热解毒类药物常用）、百草霜衣（清热解毒类药物常用）等。（2）保护衣：选用性质稳定而无明显药理作用的材料将丸剂包衣，使主药与外界隔绝而起保护作用。常见的有薄膜衣、糖衣（B错）、有色糖衣、明胶衣等。（3）肠溶衣：选用肠溶材料（如聚丙烯酸树脂Ⅰ号、Ⅱ号、Ⅲ号，纤维醋法酯等）将丸剂包衣，使之在胃液中不溶散而能在肠液中溶散。包控释衣（E错）可以改变药物释放速度，减少服药次数，降低不良反应。